女，18岁。间断排黏液脓血便伴发热2个月。每天大便10余次。体温波动在38.0~39.5℃，广谱抗生素治疗1周后症状无好转。结肠镜检查全结肠弥漫性充血、糜烂，伴溃疡形成。最可能的诊断是
A. 肠易激综合征
B. 重型溃疡性结肠炎
C. 肠结核
D. 克罗恩病
E. 慢性细菌性痢疾

正确答案：B。重型溃疡性结肠炎

解析：青少年女性患者。间断排黏液脓血便（溃疡型结肠炎的典型表现）伴发热2个月。每天大便10余次（＞6次/日，属于重度）。体温波动在38.0~39.5℃（＞37.8℃，属于重度），广谱抗生素治疗1周后症状无好转。结肠镜检查全结肠弥漫性充血、糜烂，伴溃疡形成（提示溃疡型结肠炎），故结合患者的症状、体征和实验室检查，其最可能的诊断是重型溃疡性结肠炎（B对）。肠易激综合征（A错）是一种以腹痛伴排便习惯改变为特征而无器质性病变的常见功能性肠病。肠结核（C错）一般除了下腹痛之外还有结核毒血症状：低热、盗汗等。克罗恩病（D错）是一种慢性炎性肉芽肿性疾病，多见于末段回肠和邻近结肠，但从口腔至肛门各段消化道均可受累，呈节段性分布。以腹痛、腹泻、体重下降为主要临床表现，常有发热、疲乏等全身表现，肛周脓肿或瘘管等局部表现，以及关节、皮肤、眼、口腔黏膜等肠外损害。慢性细菌性痢疾（E错）主要是非典型的细菌性痢疾的症状：腹泻、腹痛、腹胀，特点就是反复的发作，迁延不愈。